患者，女，32岁，已婚。孕后腰腹酸痛，胎动下坠，伴阴道少量出血，头晕耳鸣，小便频数，舌淡苔白，脉沉细滑。治疗应首选
A. 加味圣愈汤
B. 胎元饮
C. 举元煎
D. 补肾安胎饮
E. 寿胎丸

正确答案：E。寿胎丸

解析：患者孕后腰酸腹痛，胎动下坠，伴阴道少量出血是因为肾虚冲任失固，蓄溢养胎之阴血下泄；头晕耳鸣，小便频数，舌淡苔白，脉沉细滑是肾虚之征，治疗用寿胎丸补肾健脾，益气安胎（E对）。补肾安胎饮功效固肾安胎，主肾虚胎动不安证（D错）。加味圣愈汤功效补气，补血，摄血，用于气血虚弱，气不摄血证，多见月经先期而至，量多色淡，四肢乏力，体倦神疲（A错）。胎元饮胎元饮功效补气养血，固肾安胎，多用于胎漏、胎动不安之气血虚弱证（B错）。举元煎功效补气摄血固冲，原方治疗气虚下陷，血崩气脱，亡阳垂危等证（C错）。